睡后易醒，醒后不易入睡多见于
A. 心肾不交
B. 心脾两虚
C. 胆郁痰扰
D. 食滞内停
E. 痰湿困脾

正确答案：B。心脾两虚

解析：“失眠又称‘不寐’、‘不得眠’，是指经常不易入睡，或睡而易醒，不易再睡，或睡而不酣，易于惊醒，甚至彻夜不眠的表现。其病机是阳不入阴，神不守舍。气血不足，神失所养；阴虚阳亢，虚热内生；肾水不足，心火亢盛等，皆可扰动心神，导致失眠，属虚痰火、食积、瘀血等邪火上扰，心神不宁，亦可出现失眠，属实证。可见于心脾两虚、心肾不交、肝阳上亢、痰火扰心、食滞胃腑等证”，睡后易醒、醒后不易入睡，兼见心悸、纳少乏力、舌淡脉虚者，属心脾两虚，是因忧思伤脾，脾气虚，不能运化水谷精微，血之化源不足，导致心血虚，心神失养，而致失眠（B对）。心肾不交引起的失眠可表现为不易入睡，或彻夜不眠，兼头晕耳鸣、腰膝膝软、潮热盗汗、心悸健忘(A错)。胆郁痰扰引起的失眠可表现为睡眠而时时惊醒，兼见眩晕胸闷、胆怯心烦、口苦恶心（C错）。食滞内停引起的失眠表现为失眠而夜卧不安，兼脘闷暖气、腹胀不舒、舌苔厚腻（D错）。痰湿困脾可引起嗜睡，表现为困倦易睡，兼见头目昏沉、身重脘闷、苔腻脉濡（E错）。